某男，20岁，近日小便频数涩痛，色红，证属湿热下注、灼伤血络。宜选用的药是
A. 白及
B. 棕榈炭
C. 小蓟
D. 地榆
E. 艾叶

正确答案：C。小蓟

解析：本题考查的是小蓟的性能特点。近日小便频数涩痛，色红，证属湿热下注、灼伤血络。宜选用的药是小蓟（C对）。小蓟：【性能特点】本品苦凉清泄，甘淡渗利，入心、肝经。既凉血止血、解热毒，又兼散瘀止血、利尿导热从小便而出，善治血热出血、热毒疮肿，尿血、血淋用之尤佳。白及（A错）：【性能特点】本品涩黏能敛，苦寒清泄，甘而缓补。入肺、肝、胃经。善收敛止血，兼益肺胃，治体内外出血，最宜肺胃损伤之咳血、吐血，以及肺痈咳吐脓血。善消肿生肌，治痈疽疮疡，初起未脓服之可消，溃久不敛敷之可愈；外用冶烫伤、皮肤皲裂、肛裂。棕榈炭（B错）：【性能特点】本品涩敛苦平，入肺、肝与大肠经。专收敛止血，凡出血无论寒热虚实皆宜，治出血无瘀者最佳。地榆（D错）：【性能特点】本品苦降泄，酸收敛，微寒清，入肝、胃、大肠经。解热毒、凉血止血、消肿止痛，血热出血者宜用；又因沉降入下焦，善治下焦血热妄行诸证，为治痔疮、便血及崩漏之佳品。外用善解毒消肿、敛疮止痛，为治水火烫伤之要药。艾叶（E错）：【性能特点】本品辛香苦燥温散，生温熟热，炒炭兼敛，入肝、脾、肾经。内服炒炭温经散寒、暖宫、收敛而止血崩；生用温经散寒湿、暖宫理气血而止痛、止血、止带。外用煎汤熏洗，燥湿杀虫而止痒；温灸能温通经脉、散寒而止痛或消肿。作用偏于中下二焦，既为治妇科崩漏与带下之要药，又为灸科温灸之主药。